预防接种的免疫学效果评价对照常用
A. 自身对照
B. 邻居对照
C. 亲属对照
D. 未接种的健康人为对照
E. 该病病历为对照

正确答案：A。自身对照

解析：本题考查预防接种的免疫学效果评价。预防接种的免疫学效果评价对照常用自身对照（A对BCDE错）。通过测定接种后人群抗体阳转率、抗体平均滴度和抗体持续时间来评价免疫学效果。